某期间内因某病死亡人数与同期某病患病人数之比是
A. 患病率
B. 比值比
C. 相对危险度
D. 某病病死率
E. 某病死亡人数

正确答案：D。某病病死率

解析：本题考查病死率的概念。病死率（D对ABCE错）表示一定时期内因某病死亡者占该病病人的比例，表示某病病人因该病死亡的危险性。